为满足饮用水水质标准的要求，对作为水源水的地表水常规处理过程为
A. 过滤-混凝沉淀-消毒
B. 消毒-混凝沉淀-过滤
C. 过滤-澄清-消毒
D. 消毒-过滤-再消毒
E. 混凝沉淀-过滤-消毒

正确答案：E。混凝沉淀-过滤-消毒

解析：本题考查对作为水源水的地表水常规处理过程。以地表水为水源时，常规净化过程为：水源取水-水厂混凝沉淀（或澄清）-过滤-消毒（E对ABCD错）。常规净化可除去原水中的悬浮物质、胶体颗粒和细菌等。